功能失调性子宫出血的发病因素
A. 月经周期紊乱，经期延长，出血量时多时少，甚至大量出血，一般不伴痛经
B. 包括精神紧张、环境变化、气候骤变、过度劳累、营养不良及全身性疾病
C. 绝经后阴道出血
D. 接触性出血
E. 凝血功能异常

正确答案：B。包括精神紧张、环境变化、气候骤变、过度劳累、营养不良及全身性疾病

解析：本题考查功能失调性子宫出血的发病因素。当机体受精神紧张、环境变化、气候骤变、剧烈运动、饮食紊乱、营养不良、代谢紊乱及全身性疾病（B对ACDE错）等的影响时，可出现下丘脑-垂体-卵巢轴功能调节或靶细胞效应异常而致月经紊乱，由于下丘脑-垂体-卵巢轴发育不完善，同时雌激素分泌减少，子宫内膜失去雌激素的支持而出现雌激素的撤退性出血。